引起“恐水病”的病毒是
A. 狂犬病病毒
B. 人乳头瘤病毒
C. 人类细小病毒
D. 人类免疫缺陷病毒
E. 疱疹病毒

正确答案：A。狂犬病病毒

解析：狂犬病潜伏期为3～8周（10日至数年）。人发病时的典型临床表现是神经兴奋性增高，吞咽或饮水时喉头肌肉发生痉挛，故又称恐水病。掌握“狂犬病、人乳头瘤病毒”知识点。